甲胎蛋白
A. 自身抗原
B. 异种抗原
C. 异嗜性抗原
D. 肿瘤相关抗原
E. 肿瘤特异性抗原

正确答案：D。肿瘤相关抗原

解析：甲胎蛋白在胎儿期高表达，出生后表达逐渐降低，但是在肝细胞癌中，高表达甲胎蛋白，可知甲胎蛋白属于肿瘤相关抗原（D对）。正常情况下，机体对自身抗原（A错）（P26）不产生免疫反应，处于免疫耐受的状态，甲胎蛋白不属于自身抗原。异种抗原（B错）（P25）是指来自另一物种的抗原物质，如植物花粉，异种动物血清，各种微生物及其代谢产物等。异嗜性抗原（C错）（P25）指存在于人、动物、微生物等不同种属之间的共同抗原例如溶血性链球菌的表面成分与人肾小球基底膜及心肌组织存在共同抗原，大肠埃希菌O14型脂多糖与人结肠粘膜有共同抗原。肿瘤特异性抗原（E错）指肿瘤细胞特有的或只存在于某种肿瘤细胞而不存在于正常细胞的一类抗原。